慢性肾衰竭时少见的是
A. 高渗尿
B. 低渗尿
C. 多尿
D. 少尿
E. 夜尿

正确答案：A。高渗尿

解析：在慢性肾衰竭的不同阶段，其临床表现各异，但正常的肾结构是生成和浓缩尿液的保障，慢性肾衰竭时肾脏有实质性损害，致使不能维持基本功能，故浓缩尿液的功能也会受到影响，答案选择高渗尿（A对）。